某农药厂包装工，因敌敌畏瓶破碎浸湿上衣。工作中出现头晕、流涕、咳嗽而急诊，按感冒对症治疗。一周后症状加重，伴恶心、多汗，再次就诊。检查中医师闻到衣服上有大蒜气味，曾怀疑农药中毒，但继续对症处理，未入院。次日，患者头晕、视物模糊频繁呕吐、步态不稳，继而躁动不安，全身肌束颤动。入院后用阿托品、解磷定治疗，但不久因呼吸、心跳停止，复苏无效死亡。本病诊断中最大的疏漏是
A. 未认真做体格检查
B. 未认真听取患者主诉
C. 未认真采集职业史和病史
D. 未密切观察病情变化
E. 未进行血常规检查

正确答案：C。未认真采集职业史和病史